下列除哪项外，都是切断传播途径的措施
A. 灭鼠措施
B. 消毒措施
C. 预防性消毒措施
D. 疫源地消毒措施
E. 杀虫措施

正确答案：A。灭鼠措施

解析：本题考查切断传播途径的措施。切断传播途径的措施包括消毒（B对）和杀虫（E对）。消毒包括预防性消毒（C对）和疫源地消毒（D对）。灭鼠（A错,为本题正确答案）属于控制传染源的措施。